脾索内不含有
A. 大量B细胞
B. 浆细胞
C. 血液
D. 巨噬细胞
E. 树突细胞

正确答案：C。血液

解析：脾脏为外周免疫器官，其实质部分可以分为白髓（淋巴组织）与红髓两部分。在红髓有脾索和脾血窦组成。脾索为索条状组织，主要含B细胞、浆细胞、巨噬细胞和树突细胞。脾血窦内充满血液。掌握“中枢和外周免疫器官”知识点。